补益精血、解毒，截虐的是
A. 续断
B. 紫河车
C. 菟丝子
D. 何首乌
E. 益智仁

正确答案：D。何首乌

解析：本题考查的是何首乌的功效。补益精血、解毒，截虐的是何首乌（D对）。何首乌：【功效】补益精血，解毒，截疟，润肠通便。续断（A错）：【功效】补肝肾，行血脉，续筋骨。紫河车（B错）：【功效】温肾补精，养血益气。菟丝子（C错）：【功效】补阳益阴，固精缩尿，明目止泻，安胎，生津。益智仁（E错）：【功效】暖肾固精缩尿，温脾止泻摄唾。